男孩，1岁，确诊为先天性甲状腺功能减退症，应用L-T₄治疗，剂量为每日50ug。近几天患儿烦躁不安、多汗、腹泻，此时应
A. 先密切观察不作特殊处理
B. 改用甲状腺干粉片
C. 立即停药
D. 减少剂量
E. 増加剂量

正确答案：D。减少剂量

解析：本例患者为婴幼儿，且为先天性甲状腺功能减退患者，采用左旋甲状腺素（L2014U2-T₄）治疗，治疗期间出现烦躁不安、多汗、腹泻等亢进型药物不良反应，考虑是L-T₄剂量过量，故此时应减少剂量（D对）。